休克早期的主要体征是
A. 昏迷
B. 血压下降
C. 末梢发绀
D. 心跳加快
E. 脉压差变小

正确答案：D。心跳加快

解析：休克是由于各种原因导致的血压明显下降而引起的一种循环功能障碍。休克早期因交感神经兴奋，儿茶酚胺分泌过多，导致血管收缩，心跳加快，目的是为了使血压保持在合适的水平，保护心脑等重要器官的供血（D对）；休克中期出现神志淡漠或昏迷、尿量减少，或合并其他器官功能损伤，血压下降可至50mmHg以下，脉压差可低于20mmHg。休克晚期出现DIC或全身多器官功能不全，大脑出现意识状态变化，变为嗜睡、浅昏迷、深昏迷的状态；心功能出现血流动力学的不稳定，可出现血压下降及心肌损害；呼吸由呼吸兴奋急促转为呼吸抑制，出现血氧下降；肾功能发生损害，可出现少尿；出现肝功能损害、黄疸等（ABCE错）。